汞接触者尿汞升高的意义是
A. 慢性汞中毒指标
B. 急性汞中毒指标
C. 汞吸收指标
D. 尿汞排泄障碍
E. 汞吸收障碍

正确答案：C。汞吸收指标